不直接汇入下腔静脉的是
A. 左肾静脉
B. 右睾丸静脉
C. 右肾上腺静脉
D. 右肾静脉
E. 左睾丸静脉

正确答案：E。左睾丸静脉

解析：左肾静脉（A对）、右睾丸静脉（B对）、右肾上腺静脉（C对）、右肾静脉（D对）均直接汇入下腔静脉。左睾丸静脉（E错，为本题正确答案）注入左肾静脉。